10个月婴儿，11月3日发生腹泻，大便呈蛋花汤样，无腥臭味，每天约10次，持续3天。体温37.5～38℃，偶有咳嗽，尿量偏少。查体：体重10kg，皮肤稍干燥，眼窝稍凹陷，皮肤弹性可，粪常规未见异常。最可能的诊断是
A. 轮状病毒肠炎
B. 大肠埃希菌肠炎
C. 空肠弯曲菌肠炎
D. 细菌性痢疾
E. 真菌性肠炎

正确答案：A。轮状病毒肠炎